下列哪项不是判断因果联系的标准
A. 时间顺序
B. 联系的合理性
C. 样本大小
D. 剂量反应关系
E. 联系强度

正确答案：C。样本大小

解析：本题考查判断因果联系的标准。判断因果联系的标准包括时间顺序（A对），关联强度（E对），剂量-反应关系（D对），结果的一致性，试验证据，生物学合理性（B对），生物学一致性，特异性，相似性。样本大小（C错，为本题正确答案）不是因果关联的判定标准。